正常情况下消化道吸收水分的主要部位是
A. 胃
B. 十二指肠
C. 小肠
D. 升结肠
E. 降结肠

正确答案：B。十二指肠